下列哪项不属于细胞和组织的适应性反应
A. 肥大
B. 增生
C. 萎缩
D. 再生
E. 化生

正确答案：D。再生

解析：细胞和组织的适应性反应包括肥大（A对）、增生（B对）、萎缩（C对）、化生（E对）。再生（D错，为正确答案）是损伤在修复的一种形式。